轻度烧伤指
A. 成人Ⅱ度烧伤，面积9%以下
B. 成人Ⅱ度烧伤，面积10%～15%
C. 成人Ⅱ度烧伤，面积16%～20%
D. 成人Ⅲ度烧伤，面积10%左右
E. Ⅱ度5%以上伴头面颈部烧伤

正确答案：A。成人Ⅱ度烧伤，面积9%以下

解析：烧伤严重性分度：①轻度烧伤：Ⅱ°烧伤总面积在9%以下；②中度烧伤：Ⅱ°烧伤面积10%～29%或Ⅲ°烧伤面积不足10%；③重度烧伤：总面积30%～49%或Ⅲ°烧伤面积10%～19%或Ⅱ°、Ⅲ°烧伤面积虽不达上述百分比，但已发生休克等并发症、呼吸道烧伤或有较重的复合伤；④特重烧伤：总面积50%以上或Ⅲ°烧伤20%以上或已有严重并发症。掌握“火器伤、热烧伤”知识点。